某地在退体纺织女工中开展糖尿病的筛检，用空腹血糖作为筛检手段，按世界卫生组织筛检标准，对筛检阳性者进一步确诊。该筛检方法敏感度95%，特异度90%，根据当地退休职工的糖尿病患病率为6%，试问1000名退休职工通过筛查后发现筛检阳性人数
A. 57
B. 94
C. 60
D. 154
E. 151

正确答案：E。151